腺泡细胞癌的病理学特征是
A. 肿瘤细胞含特征性嗜碱性颗粒
B. 由肿瘤上皮与黏液样、软骨样结构构成
C. 细胞形态学上的一致性与组织结构的多样性
D. 由含嗜酸性颗粒的柱状细胞和淋巴样组织构成
E. 由黏液细胞、表皮样细胞和中间细胞构成

正确答案：A。肿瘤细胞含特征性嗜碱性颗粒

解析：本题考查腺泡细胞癌的病理学特征。腺泡细胞癌的病理学特征是肿瘤细胞含特征性嗜碱性颗粒（A对）。腺泡细胞癌病理可见肿瘤细胞呈圆形或多边形，大小一致，多具有特征性的嗜碱性颗粒状胞质，似正常腺泡细胞。多形性腺瘤的基本结构为腺上皮、肌上皮、黏液、黏液样组织和软骨样组织（B错）。细胞形态学上的一致性与组织结构的多样性（C错）的是多形性腺癌。由含嗜酸性颗粒的柱状细胞和淋巴样组织构成（D错）为Warthin瘤的病理学特征。黏液表皮样癌的肿瘤实质由黏液细胞、表皮样细胞和中间细胞构成（E错）。